在下列关于病人知情同意权的提法中，错误的是
A. 知情同意权包括知情与同意两部分权利
B. 知情同意权是病人自主权的具体形式
C. 尊重病人的知情同意权是尊重病人的体现
D. 让病人参与人体实验必须尊重其知情同意权
E. 在临床诊疗中，病人的知情同意权并不是必需的

正确答案：E。在临床诊疗中，病人的知情同意权并不是必需的